某男性患者，30岁，有吸毒史（注射）。近半年来体重减轻，发烧，口腔反复发生真菌感染。首先考虑为AIDS。为进一步确诊，需抽血检查哪项指标
A. 血常规
B. AFP
C. 抗HIV抗体
D. 针对HIV的CD8⁺细胞
E. 红细胞沉降率

正确答案：C。抗HIV抗体

解析：本题考查艾滋病的辅助检查。某男性患者，30岁，有吸毒史（注射）。近半年来体重减轻，发烧，口腔反复发生真菌感染。首先考虑为AIDS。为进一步确诊，需抽血检查抗HIV抗体（C对）。血常规（A错）、红细胞沉降率（E错）为非特异性检查，无诊断意义。AFP（B错）可用来协助诊断肝癌等恶性肿瘤。HIV侵犯机体的靶细胞为CD4⁺T淋巴细胞，可做CD4⁺T淋巴细胞检测，无需做CD8⁺T淋巴细胞检测（D错）。